电击伤的急救措施不包括
A. 脱离电源
B. 呼吸心跳停止者进行人工呼吸，心脏按压
C. 有灼伤部位进行相应处理
D. 对症治疗
E. 用冰袋凉敷头部，保护脑组织

正确答案：E。用冰袋凉敷头部，保护脑组织

解析：本题考查儿童电击伤的急救措施。脑出血时患者大脑会处于缺氧状态，为了保护患者的脑组织，可以首选冰袋冷敷头部（E错，为本题正确答案），也是抢救脑出血的最好选择。电击伤的急救与护理有：立即脱离电源（A对），呼吸心跳停止者进行人工呼吸，心脏按压（B对），有灼伤部位进行相应处理（C对），对症治疗（D对），防止并发症等。